根尖周脓肿的脓液自然引流的主要途径为
A. 根尖孔-根管内-龋洞
B. 根尖周-骨膜下-黏膜下
C. 骨髓腔-面部间隙-皮下
D. 根尖周-骨髓腔-鼻腔
E. 根尖周-骨髓腔-上颌窦

正确答案：B。根尖周-骨膜下-黏膜下

解析：本题考查根尖周脓肿的排脓途径。根尖周脓肿的脓液自然引流的主要途径为根尖周-骨膜下-黏膜下（B对）。急性化脓性根尖周炎有三大排脓方式：1.通过骨髓腔突破骨膜、黏膜或皮肤向外排脓：此排脓方式是急性根尖周炎最常见的典型自然发展过程，临床上可见到以下4种排脓途径：穿通骨壁突破黏膜、穿通骨壁突破皮肤、突破上颌窦壁（临床上较为少见）、突破鼻底黏膜（极为罕见）；2.通过根尖孔经根管从冠部缺损处排脓（A错）：这种排脓方式对根尖周组织的破坏最小，患牙以此方式进行排脓需具备的条件：根尖孔粗大、根管通畅、冠部缺损（如龋洞）呈开放状态；3.通过牙周膜从龈沟或牙周袋排脓：成人患牙经此方式排脓多发生于同时患有牙周炎的情况，通常预后较差。综上所述，穿通骨壁突破骨膜、黏膜或皮肤向外排脓为最常见的排脓方式；通过牙周膜从龈沟或牙周袋排脓是预后最差的排脓方式；穿通根尖孔经根管从冠部缺损排脓是最理想的排脓方式。